心肌不会产生强直收缩的原因是
A. 心肌是功能上的合胞体
B. 肌浆网不发达，Ca²⁺贮存少
C. 有效不应期特别长
D. 有自律性，会自动节律收缩
E. 心肌呈“全或无”式收缩

正确答案：C。有效不应期特别长

解析：心肌不产生完全强直收缩是由于有效不应期特别长（C对），有效不应期一直延续到舒张早期，在此期间心肌细胞不再接受任何强度的刺激而产生兴奋和收缩，所以不会发生完全强直收缩，从而保证心脏泵血活动的正常进行。心肌可看做一个功能合胞体（A错），从而保证了心肌的同步收缩（P111），亦称心肌的“全或无”式收缩（E错）。心肌细胞肌浆网不发达，Ca²⁺贮存少（B错），导致其兴奋-收缩耦联过程高度依赖于细胞外Ca²⁺的内流（P111-P112）。有自律性（P109），会自动节律收缩（D错）与心肌会不会发生强直收缩无关。